心肌缺血时，牵涉痛通常发生在
A. 下腹部和腹股沟区
B. 左肩胛和右肩胛
C. 心前区、左肩和左上臂
D. 上腹部和脐周围区
E. 左上腹和肩胛间

正确答案：C。心前区、左肩和左上臂